早餐提供的能量应占三餐总能量的合适比例为
A. 0.25～0.3
B. 0.35～0.45
C. 0.45～0.55
D. 0.1～0.2
E. 0.5～0.6

正确答案：A。0.25～0.3

解析：本题考查膳食能量分布的相关内容。一日三餐食物供能亦应适当，即早餐供能应占一日总能量的25%～30%（A对BCDE错），中餐应占总能量的35%～45%，点心占总能量的10%，晚餐应占总能量的25%～30%。